对映异构体之间具有相同的药理作用和强弱不同的手性药物是
A. 氯苯那敏
B. 普罗帕酮
C. 扎考必利
D. 氯胺酮
E. 氨已烯酸

正确答案：A。氯苯那敏

解析：本题考查药物的手性结构对药物活性的影响。对映异构体之间具有相同的药理作用和强弱不同的手性药物是氯苯那敏（A对）。抗过敏药氯苯那敏，其右旋体的活性高于左旋体。手性药物的两个对映体之间的药理作用和强度以及与消旋体之间没有明显差异，如对普罗帕酮（B错）抗心律失常的作用而言，其两个对映体的作用是一致的。抗精神病药扎考必利（C错）对映异构体之间产生相反的活性。氯胺酮（D错）一种对映体具有药理活性，另一对映体具有毒性作用。药物中只有一个异构体有药理活性，而另一个没有或几乎没有活性，例如抗高血压药物L-甲基多巴，仅L-构型的化合物有效。氨已烯酸（E错）只有S-对映体是GABA转氨酶抑制剂。